不正确的是
A. 耻骨前弯是阴茎根与体之间的弯曲
B. 耻骨下弯位于耻骨联合的下方,凹向上
C. 耻骨前弯位于耻骨联合的前下方,凹向下
D. 耻骨前弯由尿道膜部和尿道海绵体部构成
E. 向上提阴茎时，耻骨前弯可变直

正确答案：D。耻骨前弯由尿道膜部和尿道海绵体部构成

解析：耻骨前弯是阴茎根与体之间的弯曲（A对）。耻骨下弯位于耻骨联合的下方2cm处，凹向上（B对）即凸向下。耻骨前弯位于耻骨联合的前下方，凹向下（C对）即凸向上。尿道前列腺部、膜部和尿道海绵体部构成（D错，为本题正确答案）耻骨下弯。阴茎勃起或将阴茎向上提起时，耻骨前弯可变直而消失（E对）。